慢性菌痢的病程时限是
A. 超过1年
B. 超过6个月
C. 超过2个月
D. 超过2周
E. 时限不定，反复发作

正确答案：C。超过2个月

解析：慢性菌痢多为急性菌痢反复发作或迁延不愈，病程超过2个月。多与急性期治疗不及时或不彻底，细菌耐药或机体抵抗力低下有关。也常因饮食不当、受凉、劳累或精神因素等诱发（C对）。